机体免疫系统识别和清除突变细胞的功能是
A. 免疫监视
B. 免疫耐受
C. 免疫缺陷
D. 免疫调节
E. 免疫防御

正确答案：A。免疫监视

解析：机体的免疫功能可以概括为：1.免疫防御（E错）：防止外界病原体的入侵及清除已入侵病原体…2.免疫监视（A对）：随时发现和清除体内出现的“非己”成分…3.免疫自身稳定：通过自身免疫耐受和免疫调节（D错）两种主要的机制来达到免疫系统内环境的稳定。一般情况下，免疫系统对自身组织细胞不产生免疫应答，称为免疫耐受（B错）。